辛夷入汤剂宜
A. 烊化
B. 冲服
C. 后下
D. 包煎
E. 先煎

正确答案：D。包煎

解析：该题考查辛夷的特殊煎药方法。包煎（P44）：主要指那些粘性强、粉末状及带有绒毛的药物…如蛤粉、滑石、青黛、旋覆花、车前子、蒲黄、灶心土等。辛夷有毛，入汤剂易刺激咽喉，宜包煎。（D对）烊化（P44）：又称溶化，主要是指某些胶类药物…加热烊化后服用（A错）。冲服（P44）：主要指某些贵重药，用量较轻…如麝香、牛黄、珍珠、羚羊角、西洋参等（B错）。后下（P44）：主要指一些气味芳香的药物…亦属后下之列（C错）。先煎（P43）：主要指有效成分难溶于水的一些金石、矿物…久煎可以降低毒性，安全用药（E错）。